治疗妊娠期高血压脾虚证，应首选
A. 天仙藤散
B. 白术散
C. 真武汤
D. 肾气丸
E. 四苓散

正确答案：B。白术散

解析：妊娠高血压脾虚者治宜健脾温阳，行水消肿，白术散为治疗高血压脾虚证的首选方剂（B对）。天仙藤散（A错）功效主要是理气性滞，除湿消肿，治疗妊娠高血压的气滞湿阻证为首选药。真武汤（C错）具有温阳利水，壮肾阳之效，治疗脾肾阳虚之水气停的阳虚水泛证。肾气丸（D错）以六味地黄丸为主加附、桂，功在温补肾阳，治疗腰腿酸软，小便反多的肾阳不足证。四苓散（E错）主治利水渗湿，用于水湿泄泻，小便不利，非妊娠高压脾虚证。